听觉性语言中枢位于
A. 颞中回后部
B. 颞上回后部
C. 角回
D. 颞横回
E. 额下回后部

正确答案：B。颞上回后部

解析：听觉性语言区在颞上回后部（B对）。